对射精管的描述中，正确的是
A. 位于膀胱上方
B. 由输精管末端和精囊腺排泄管汇合而成
C. 开口于尿道膜部
D. 穿尿生殖膈，开口于尿道膜部
E. 以上都不对

正确答案：B。由输精管末端和精囊腺排泄管汇合而成

解析：由输精管末端和精囊腺排泄管汇合而成（B对）射精管。开口于尿道前列腺部（C错）。